药物经济学研究中，用药结果表达形式包括
A. 效果
B. 效益
C. 效用
D. 效价
E. 效率

正确答案：A、B、C。效果；效益；效用

解析：本题考查药物经济学研究。药物经济学评价的用药结果主要有三种形式：①效果（A对）：以客观指标表示的用药结果，如发病率、治愈率、不良反应发生率等；②效益（B对）：转化为货币值的用药结果；③效用（C对）：以主观指标表示的用药结果，如患者对治疗结果的满意程度、舒适程度和与健康相关的生活质量等。